心肺气虚、脾肺气虚和肺肾气虚三证的共同症状是
A. 胸闷心悸
B. 心悸怔忡
C. 咳喘无力
D. 食少腹胀
E. 腰酸耳鸣

正确答案：C。咳喘无力

解析：“心肺气虚证，临床表现为 胸闷，咳嗽，气短而喘，心悸，动则尤甚，吐痰清稀，神疲乏力，声低懒言，自汗，面色淡白，舌淡苔白，或唇舌淡紫，脉弱或结或代；脾肺气虚证，临床表现为食欲不振，食少，腹胀，便溏，久咳不止，气短而喘，咯痰清稀，面部虚浮，下肢微肿，声低懒言，神疲乏力，面白无华，舌淡，苔白滑，脉弱；肺肾气虚证，临床表现为咳嗽无力，呼多吸少，气短而喘，动则尤甚，吐痰清稀，声低，乏力，自汗，耳鸣，腰膝酸软，或尿随咳出，舌淡紫，脉弱，心肺气虚、脾肺气虚、肺肾气虚三证，均有肺气虚，呼吸功能减退，而见咳喘无力、气短、咯痰清稀等症。心肺气虚证则兼有心悸怔忡、胸闷等心气不足的证候；肺脾气虚证则兼有食少、腹胀、便溏等脾失健运的证候；肺肾气虚证则兼有呼多吸少、腰酸耳鸣、尿随咳出等肾失摄纳的证候”，故心肺气虚、脾肺气虚和肺肾气虚三证的共同症状是咳喘无力（C对）。胸闷心悸和心悸怔忡均仅见于心肺气虚证（AB错)。食少腹胀仅见于脾肺气虚证（D错）。腰酸耳鸣仅见于肺肾气虚证（E错）。